男孩，1岁。发热8天，皮疹3天入院。外院抗生素治疗7天无效。查体：T39C，烦躁不安，全身淡红色斑丘疹，双眼结膜充血，口唇鲜红，干裂，草莓舌右颈淋巴结蚕豆大，质硬有压痛。双肺呼吸音粗，心率130次/分，腹软，肝脾无肿大，指、趾端硬性肿胀。实验室检查：血WBC19×10⁹/L,N0.78,L0.22,PLT420×10⁹/L，血沉120mm/h，血培养（-）。首选的治疗措施是
A. 丙种球蛋白+糖皮质激素
B. 对症治疗，观察
C. 丙种球蛋白+阿司匹林
D. 阿司匹林+糖皮质激素
E. 青霉素

正确答案：C。丙种球蛋白+阿司匹林

解析：婴幼儿，发热8天，皮疹3天，查体：39℃，烦躁不安，全身淡红色丘疹，双眼结膜充血，口唇鲜红，干裂，草莓舌右颈部淋巴结蚕豆大（川崎病的特征性体征），质硬有压痛，双肺呼吸音粗，心率130次/分（正常值为60-100次/分，心率增快），指、趾端硬性肿胀（川崎病特征性体征），实验室检查：血WBC19×10⁹/L（正常值为4-10×10⁹/L，白细胞升高），N0.78（正常值为0.5-0.7，中性粒细胞升高），L0.22（正常值为0.2-0.4），PLT420×10⁹/L（正常值为100-300×10⁹/L，血小板升高），血沉120mm/h（正常值为0-20mm/h，血沉加快），血培养（-），根据患儿的临床症状、体征、实验室检查，考虑最可能的诊断为川崎病，所以首选的治疗措施是丙种球蛋白+阿司匹林（C对），而不是对症治疗，观察（B错）。糖皮质激素可在丙种球蛋白治疗无效，或存在丙种球蛋白耐药风险的情况下考虑早期使用糖皮质激素，可与阿司匹林和双嘧达莫合并应用（AD错），青霉素（E错）对该病的治疗无效。